能够降低心力衰竭死亡率和再住院率，改善患者长期预后的药物有
A. 地高辛
B. 呋塞米
C. 比索洛尔
D. 依那普利
E. 沙库巴曲缬沙坦

正确答案：C、D、E。比索洛尔；依那普利；沙库巴曲缬沙坦

解析：本题考查心力衰竭。能够降低心力衰竭死亡率和再住院率，改善患者长期预后的药物有比索洛尔（C对）、依那普利（D对）、沙库巴曲缬沙坦（E对）。地高辛（A错）为强心苷类正性肌力药，临床主要用于急、慢性心力衰竭，控制心房颤动，心房扑动引起的快速心室率，室上性心动过速。呋塞米（B错）作为袢利尿剂，作用于髓袢升支粗段，抑制Na⁺-K⁺-2Cl⁻协转运体，使NaCl重吸收减少，影响肾的稀释与浓缩功能，发挥利尿作用。